乳母的营养状况对乳汁中营养成分有一定的影响，不包括
A. 蛋白质
B. 脂肪
C. 维生素A
D. 水溶性维生素
E. 钙

正确答案：E。钙